某医师欲开办诊所，在申请诊所程序的过程中租借李某医师诊所的《医疗机构职业许可证》，因雇佣的护士操作不当致使一名患者死亡，那么李某出借许可证的行为需要承担的法律责任
A. 罚款
B. 警告
C. 吊销执业证
D. 训诫
E. 暂扣许可证

正确答案：C。吊销执业证

解析：租借李某医师诊所的《医疗机构职业许可证》以营利为目的、护士操作不当致使一名患者死亡给患者造成伤害（C对）。